单纯疱疹复发的次数与循环抗单纯疱疹病毒抗体水平
A. 呈正比
B. 成反比
C. 无关
D. 先成正比后稳定
E. 先成反比后稳定

正确答案：C。无关

解析：单纯疱疹复发的原因还不清楚，对单纯疱疹病毒感染的免疫学研究显示，单纯疱疹复发的次数与循环抗单纯疱疹病毒抗体水平无关，说明该抗体保护作用有限。掌握“口腔单纯疱疹”知识点。